关于眼用药物吸收途径及影响因素的叙述，正确的有
A. 滴眼剂仅经结合膜单一途径吸收
B. 滴眼剂的刺激性较大时，能影响药物的吸收利用、降低药效
C. 滴眼剂的表面张力越小，越有利于药物与角膜的接触，使药物容易渗入
D. 滴眼剂的黏度增大，可使药物与角膜接触时间延长，有利于药物吸收
E. 滴眼剂的黏度增大，可降低药物的刺激性

正确答案：B、C、D、E。滴眼剂的刺激性较大时，能影响药物的吸收利用、降低药效；滴眼剂的表面张力越小，越有利于药物与角膜的接触，使药物容易渗入；滴眼剂的黏度增大，可使药物与角膜接触时间延长，有利于药物吸收；滴眼剂的黏度增大，可降低药物的刺激性

解析：本题考查眼用药物吸收途径及影响因素。滴眼剂的刺激性较大时，能影响药物的吸收利用、降低药效（B对）；滴眼剂的表面张力越小，越有利于药物与角膜的接触，使药物容易渗入（C对）；滴眼剂黏度大，可使药物与角膜接触时间延长，有利于药物吸收（D对）；滴眼剂黏度大时，药物的刺激性会降低（E对）；滴眼剂不仅经结合膜吸收，还可经角膜吸收（A错）。